下列提示颅后窝骨折的临床表现是
A. 脑脊液鼻漏
B. Battle征
C. 视神经损伤
D. 眼镜征
E. 嗅神经损伤

正确答案：B。Battle征

解析：颅后窝骨折在乳突和枕下部可见皮下瘀斑（Battle征）（B对）；眼镜征（D错）、脑脊液鼻漏（A错）、嗅神经损伤（E错）视神经损伤（C错）多为颅前窝骨折的临床表现。